阴郄位于
A. 在前臂内侧，当尺侧腕屈肌腱的桡侧缘，腕横纹上1寸
B. 在前臂外侧，当尺侧腕屈肌腱的桡侧缘，腕横纹上0.5寸
C. 在前臂内侧，当尺侧腕屈肌腱的尺侧缘，腕横纹上1寸
D. 在前臂内侧，当尺侧腕屈肌腱的桡侧缘，腕横纹上0.5寸
E. 在前臂内侧，当桡侧腕屈肌腱的桡侧缘，腕横纹上1寸

正确答案：D。在前臂内侧，当尺侧腕屈肌腱的桡侧缘，腕横纹上0.5寸

解析：阴郄定位在前臂前区，腕掌侧远端横纹上0.5寸，尺侧腕屈肌腱的桡侧缘（D对）。